诊断黄体萎缩不全功血的可靠依据是
A. 孕激素分泌量少
B. 月经第5天内膜有分泌反应
C. 雌激素分泌过多
D. 宫颈粘液呈椭圆体型
E. 基础体温呈双相

正确答案：B。月经第5天内膜有分泌反应

解析：正常月经期第3～4日时，分泌期内膜已全部脱落，代之以再生的增生期内膜。但在子宫内膜不规则脱落（黄体萎缩不全）时，于月经期第5～6日仍能见到呈分泌反应的内膜。掌握“功能失调性子宫出血”知识点。